情志抑郁与下列哪个生理功能失调最有关系
A. 肝升太过
B. 神不守舍
C. 心神不足
D. 髓海空虚
E. 肝失疏泄

正确答案：E。肝失疏泄

解析：肝主疏泄，指肝具有维持全身气机疏通畅达，通而不滞，散而不郁的生理功能。肝主疏泄的中心环节是调畅气机。肝气疏通、畅达全身气机，使脏腑经络之气的运行通畅无阻，升降出入运动协调平衡，从而维持了全身脏腑、经络、形体、官窍等功能活动的有序进行。肝气的疏泄作用失常，称为肝失疏泄。其病机主要有三个方面：一为肝气郁结，疏泄失职。临床多见情志抑郁（E对），善太息，胸胁、两乳或少腹等部位胀痛不舒等症。二是肝气亢逆，疏泄太过。临床表现为情志急躁易怒，头痛头胀，面红目赤，胸胁、乳房走窜胀痛，或血随气逆而吐血、咯血，甚则突然昏厥（A错）。三是肝气虚弱，疏泄不及，升发无力，表现出一系列因虚而郁滞的临床表现，如情志抑郁、胆怯、懈怠乏力、头晕目眩、两胁虚闷、时常太息、脉弱等；神不守舍、心神不足是对心主神明、心藏神功能的体现（BC错）；髓海空虚是对肾主生髓化血功能的体现。肾藏精，精能生髓，精髓不仅可上充脑髓，还可充养脊髓、骨骼等组织器官，促进骨骼的生长发育，使骨骼健壮有力、牙齿坚固等。当肾精不足，化髓减少，可导致精髓亏虚、骨失充养而影响骨的生长发育，如骨质疏松、牙齿早脱等（D错）。